视网膜感光最敏锐的部分是
A. 视神经盘
B. 视盘陷凹
C. 黄斑
D. 黄斑区的中央凹
E. 黄斑外侧的部分

正确答案：D。黄斑区的中央凹

解析：黄斑的中央凹（D对）由密集的视锥细胞构成，且无血管走行，是视网膜感光最敏锐的部分，而非黄斑（C错）或黄斑外侧的部分（E错）。视神经盘（A错）的视盘凹陷（B错）无感光细胞，且视网膜中央动、静脉穿过，被称为生理性盲点。